男性，54岁，骨病变活检镜下见皮质骨表现为层板骨纹理结构粗糙，部分骨细胞消失，骨陷窝空虚，并可见微裂；骨髓小动脉内膜、内弹力层消失，肌层纤维化，外膜增厚。病理诊断应为
A. 放射性骨坏死
B. 骨纤维异常增殖症
C. 家族性巨颌症
D. 朗格汉斯细胞组织细胞增生症
E. 慢性局灶性硬化性骨髓炎

正确答案：A。放射性骨坏死

解析：本题考查放射性骨髓炎的病理变化。放射性骨髓炎的早期病理变化，皮质骨比松质骨更明显，层板骨纹理结构粗糙，部分骨细胞消失，骨陷窝空虚，并可见微裂，成骨和破骨现象均不明显；血管变化不突出，可见小动脉内膜、内弹力层消失，肌层纤维化，外膜增厚（A对）。骨纤维异常增殖症为发育畸形，X线表现为颌面骨广泛性或局限性沿骨长轴方向发展，呈不同程度的弥散性膨胀，界限模糊（B错）。巨颌症仅发生于儿童，男性多见，镜下见病变处骨组织被富于血管的纤维结缔组织代替，后期纤维成分增多，巨细胞减少，可见新骨形成（C错）。朗格汉斯细胞组织细胞增生症是以朗格汉斯细胞增生、嗜酸性粒细胞浸润为主的病变（D错）。慢性局灶性硬化性骨髓炎又称致密性骨炎，病变区骨小梁比周围正常骨组织致密，主要是由编织骨和板层骨构成的不规则的骨小梁（E错）。